男性，60岁。患牙偶有与体位有关的自发痛。检查发现：无明显龋损及其他牙体硬组织病变。牙髓活力测验敏感。叩诊（-），无松动，牙周检查（-）。X线片示：髓腔内有阻射物。应诊断为
A. 牙髓坏死
B. 可复性牙髓炎
C. 牙髓钙化
D. 残髓炎
E. 逆行性牙髓炎

正确答案：C。牙髓钙化

解析：本题考查牙髓钙化。男性，60岁。患牙偶有与体位有关的自发痛。检查发现：无明显龋损及其他牙体硬组织病变。牙髓活力测验敏感。叩诊（-），无松动，牙周检查（-）。X线片示：髓腔内有阻射物。应诊断为牙髓钙化（C对）。根据题目中的信息患牙偶有与体位有关的自发痛，X线片示髓腔内有阻射物，可诊断为牙髓钙化。牙髓坏死牙冠变色，牙髓电活力测验无反应，X线显示根尖周影像无明显异常（A错）。可复性牙髓炎无自发痛，检查可见接近髓腔的牙体硬组织病损（B错）。残髓炎患牙牙冠可见做过牙髓治疗的充填材料或暂封材料，叩诊有轻微疼痛或不适（D错）。逆行性牙髓炎为牙周-牙髓联合病变的一种，可见深牙周袋，而患者牙周检查（-），故（E错）。